一次给药药物作用持续时间相对较长的给药途径是
A. 经皮给药
B. 直肠给药
C. 吸入给药
D. 口腔黏膜给药
E. 静脉给药

正确答案：A。经皮给药

解析：本题考查药物的给药方式。经皮给药（A对）一次给药作用持续时间相对较长。经皮给药制剂系指药物由皮肤吸收进入全身血液循环并达到有效血药浓度，但药物须穿过皮肤角质层屏障，起效慢，通常用作局部给药。直肠给药（B错）将药物栓剂或药物液体导入直肠内由直肠黏膜血管吸收，可避免胃肠道刺激及药物被破坏；吸入给药（C错）能产生局部或全身治疗作用，剂型有吸入气雾剂，供雾化用的液体制剂和吸入粉雾剂等；口腔黏膜给药（D错）可避免首过效应，增加生物利用度，适用于口服不稳定，有刺激性的药物；静脉给药（E错）不存在吸收过程，药物直接进入血液循环进行分布，生物利用度为100%。